以上哪种疾病的病理特点是骨膜下形成反应性新骨
A. 结核性骨髓炎
B. 放射性骨髓炎
C. Garré骨髓炎
D. 慢性化脓性骨髓炎
E. 急性化脓性骨髓炎

正确答案：C。Garré骨髓炎

解析：Garré骨髓炎镜下见骨膜下反应性新骨形成为本病的特点。掌握“Garré骨髓炎及致密性骨炎”知识点。